在行下牙槽神经麻醉口内注射后，将注射针退出多少可行舌神经阻滞麻醉
A. 退出0.1cm
B. 退出0.5cm
C. 退出1.0cm
D. 退出1.5cm
E. 退出2.0cm

正确答案：C。退出1.0cm

解析：舌神经阻滞麻醉注射方法：在行下牙槽神经麻醉口内注射后，将注射针退出1cm，此时注射麻药0.5～1ml，即可麻醉舌神经，或在退针时，边退边注射麻醉药，直到针尖退至黏膜下为止。掌握“颌面部常用局麻法及牙拔除的麻醉选择”知识点。